治疗洋地黄中毒引起的室性早搏，应首选的药物是
A. 奎尼丁
B. 利多卡因
C. 阿托品
D. 美托洛尔
E. 苯妥英钠

正确答案：E。苯妥英钠

解析：洋地黄中毒引起的快速性心律失常可用利多卡因或苯妥英钠治疗，利多卡因可治疗室性心动过速和心室纤颤，而苯妥英钠（E对）不仅可以对抗洋地黄引起的心律失常，还能与洋地黄竞争Na+-K+-ATP酶，恢复该酶活性，有解毒效应，因而治疗效果比利多卡因（B错）更好。奎尼丁（A错）为ⅠA类抗心律失常药物，主要用于治疗房性和室性期前收缩；阿托品（C错）可用于洋地黄中毒有传导阻滞和缓慢性心律失常者；美托洛尔（D错）为β受体阻滞剂，主要用于慢性心衰、房颤心室率的控制等。